颗粒剂制备时，包合挥发油可采用的材料是
A. 糊精
B. β-环糊精
C. 淀粉
D. 药粉
E. 枸橼酸、碳酸钠

正确答案：B。β-环糊精